属于肿瘤过继免疫疗法的是
A. 注射BCG
B. 注射IL-2
C. 注射TIL
D. 注射病毒性肿瘤疫苗
E. 注射McAb¹²⁵I

正确答案：C。注射TIL